患病率指标来自
A. 现况调查资料
B. 门诊病例资料
C. 住院病例资料
D. 专科医院病例资料
E. 对所有病人的调查

正确答案：A。现况调查资料

解析：本题考查患病率指标的来源。患病率指标的来源多是从现况调查（A对BCDE错）、筛检资料中获得的。